下列哪项不是浅龋的临床表现
A. 平滑面釉质白垩斑点
B. 患者无症状
C. 窝沟色泽变黑，可卡探针
D. 对化学性刺激有反应
E. 探针检查时有粗糙感

正确答案：D。对化学性刺激有反应

解析：本题考查浅龋的临床表现。浅龋遭受外界物理或化学刺激无明显反应（D错，为本题的正确答案）。浅龋主要表现为釉质色形质的改变。平滑面早期浅龋一般呈白垩色点或斑（A对）。浅龋位于釉质内，患者一般无主观症状（B对）。窝沟龋表现为龋损部位色泽变黑，用探针检查可卡住探针（C对）。浅龋用探针检查时可有粗糙感（E对）。